关于牙釉质龋病损体部描述哪项是错误的
A. 偏振光显微镜呈正双折射，其颜色与暗层相似
B. 该层孔隙所占容积在边缘区较少，中心区较多
C. 牙釉质横纹及生长线比别的区更清楚
D. 该层晶体直径可减少至10～30nm
E. 病损体部脱矿为4个区中最严重

正确答案：A。偏振光显微镜呈正双折射，其颜色与暗层相似

解析：本题考查牙釉质龋-病损体部。关于牙釉质龋病损体部描述错误的是偏振光显微镜呈正双折射，其颜色与暗层相似（A错，为本题的正确答案）。在偏振光下病损体部呈正双折射，与暗层之间界限清楚，颜色不同。测量分析表明，孔隙容积在边缘处相对较少，中心区较多（B对）。在病损体部，牙釉质横纹及生长线比别的区更清楚（C对）。病损体部的晶体直径可减少至10～30nm（D对）。病损体部是釉质龋病变的主要部分，为釉质龋中脱矿最严重的层次（E对），且在所有病损中都存在。